穿过三边孔的动脉
A. 椎动脉
B. 旋肩胛动脉
C. 腋动脉
D. 旋肱后动脉
E. 旋肱前动脉

正确答案：B。旋肩胛动脉

解析：旋肩胛动脉（B对）穿过三边孔至冈下窝附近诸肌，并与肩胛上动脉吻合。